伤寒见胸部红疹者，其证型是
A. 湿遏卫气
B. 湿热中阻
C. 热入营血
D. 气随血脱
E. 阴虚内热

正确答案：C。热入营血

解析：胸部红疹为病程7～14天出现的淡红色斑丘疹，直径2～4mm，压之褪色，称为玫瑰疹。本病为湿热病邪所致，需分清卫气营血的深浅层次，热入营血（C对）迫血妄行，可见胸部红疹；湿遏卫气（A错）的临床表现是发热恶寒，身重头痛，体倦纳呆，胸闷腹胀，便秘或便溏，舌淡红，苔白腻，脉濡缓；湿热中阻（B错）表现为身热不退，有汗不解，脘腹胀满，渴不多饮，神情呆滞，耳聋重听，便溏不爽，舌红苔黄腻，脉濡数；气随血脱（D错）表现为便血不止，面色苍白，汗出肢冷，舌淡无华，脉微细；阴虚内热（E错）表现为低热不退，胸腹痞满，食少倦怠，舌红少苔，脉细数。